种植体植入术的并发症，以下说法正确的是
A. 伤口裂开后，一般不用处理
B. 术后出血，提倡及早热敷
C. 下唇麻木多因术中损伤颏神经或下牙槽神经所致
D. 穿通上颌窦粘膜，一般不用处理
E. 提倡早期热敷，促进伤口愈合

正确答案：C。下唇麻木多因术中损伤颏神经或下牙槽神经所致

解析：种植体植入术的并发症①创口裂开：缝合过紧或过松，尤其在诱发感染的情况下更易发生。应及时清创，再次缝合。②出血：因黏骨膜剥离损伤大或黏膜下广泛剥离，术后压迫不够导致。提倡在术后早期冷敷，晚期热敷。③下唇麻木：多因术中损伤颏神经或下牙槽神经所致。前者多可恢复。后者应去除种植体，避开神经重新植入。④窦腔黏膜穿通：上颌种植时，由于骨量不足，容易穿通上颌窦或鼻底黏膜，应及时去除种植体。⑤感染。⑥牙龈炎：种植义齿修复后，由于口腔卫生不良或清洁方法不当所致。⑦牙龈增生：由于基桩穿龈过少或与桥架连接不良所致。⑧进行性边缘性骨吸收：多发生在种植体颈部的骨组织，与牙龈炎、种植体周围炎、种植体应力过于集中以及种植体机械折断长时间未纠正有关。⑨种植体创伤：常见于种植体义齿被意外撞击，可致种植体轻微松动。⑩种植体机械折断：主要因机械因素或应力分布不合理所致。掌握“牙种植手术及效果评估”知识点。